男性，20岁。乏力、发热、全身痛，皮肤瘀斑半月余，查体：贫血貌，体温38℃，心肺（﹣），胸骨有压痛，肝肋下1.5cm，脾肋下1cm，血红蛋白60g/L，白细胞总数2×10⁹/L，血小板20×10⁹/L，最可能的诊断是
A. 再生障碍性贫血
B. 溶血性贫血缺铁性贫血
C. 巨幼红细胞性贫血
D. 血小板减少性紫癜
E. 急性白血病

正确答案：E。急性白血病